下列营养素中，可用红细胞溶血试验来评价营养状况的是
A. 维生素A
B. 维生素B₁
C. 维生素C
D. 维生素D
E. 维生素E

正确答案：E。维生素E